不属于经络学说临床应用的是
A. 通过经络望诊帮助诊断疾病
B. 依据经络学说指导针灸临床选穴
C. 依据经络学说指导刺灸方法的选用
D. 经络可以运行气血，濡养周身
E. 指导药物归经

正确答案：D。经络可以运行气血，濡养周身

解析：经络的作用：①联系脏腑，沟通内外。②运行气血，营养全身第十版针灸学（D错，为本题正确答案）。③抗御病邪，反映病候。④传导感应，调和阴阳。经络学说的临床应用：诊断方面为经络辨证、经络望诊（A对）、经络腧穴按诊和经络腧穴电测定；治疗方面为指导针灸治疗（指导针灸临床选穴）（B对）和指导刺灸方法的选用（C对）和指导药物归经（E对）。